关于药物在体内的相互作用叙述错误的是
A. 包括药动学和药效学两个方面
B. 竞争血浆蛋白结合
C. 影响生物转化
D. 用药种数越多，不良反应发生率也越低
E. 影响药物排泄

正确答案：D。用药种数越多，不良反应发生率也越低

解析：药物相互作用指同一时间或间隔一定时间两种或两种以上药物合用，药物与药物之间或药物与机体之间产生的相互影响。一般而言，用药种数越多，不良反应发生率也越高（D错，为本题正确答案）。物在体内的相互作用包括药动学和药效学两个方面（A对）。药动学方面包括①妨碍吸收②竞争血浆蛋白结合（B对）③影响生物转化（C对）④影响药物排泄（E对）。